关于肽的叙述，错误的是
A. 2个以上氨基酸借肽键连接而成的化合物
B. 组成肽的氨基酸分子都不完整
C. 多肽与蛋白质分子之间无明确的分界线
D. 肽没有氨基末端和羧基
E. 肽分为寡肽和多肽

正确答案：D。肽没有氨基末端和羧基